中鼻道
A. 有筛窦后组的开口
B. 有蝶窦开口
C. 有上颌窦开口
D. 有鼻泪管开口
E. 有额窦和筛窦后组的开口

正确答案：C。有上颌窦开口

解析：上颌窦有窦的开口通入中鼻道半月裂孔 （C对）。筛窦前、中群开口于中鼻道，后群开口于上鼻道 （AE错）。蝶窦向前开口于蝶筛隐窝 （B错）。下鼻道前上方有鼻泪管开口（D错）。